患者突然昏倒，不知人事，呼吸气粗，口噤握拳，舌苔薄白，脉伏。其证候是
A. 气厥实证
B. 气厥虚证
C. 血厥实证
D. 血厥虚证
E. 痰厥

正确答案：A。气厥实证

解析：题中患者以突然昏倒，不知人事为主症，故诊断为厥证，突然昏倒，不知人事，呼吸气粗，口噤握拳为忧思郁怒，肝失条达，郁闷不舒，气机上逆，壅滞心胸，內闭神机所致，脉伏为阳气闭郁于内，故辨为气厥实证（A对）。气厥虚证以发作时眩晕昏仆，面色苍白，呼吸微弱，汗出肢冷为主症，舌淡，脉沉细微（B错）。血厥实证多因急躁恼怒而发，以突然昏倒，不知人事，牙关紧闭，面赤唇紫为主症，舌黯红，脉弦有力（C错）。血厥虚证多因失血过多等原因所致，以突然昏厥，面色苍白，口唇无华，四肢震颤，自汗肢冷，目陷口张，呼吸微弱为主症，舌质淡，脉芤或细数无力（D错）。痰厥常因咳喘宿痰，多湿多痰，恼怒或剧烈咳嗽所致，以突然昏厥，喉有痰声，或呕吐涎沫，呼吸气粗为主症，舌苔白腻，脉沉滑（E错）。